男，28岁，胸膝位三点见肛门红肿，有触痛，诊断为
A. 直肠间隙脓肿
B. 直肠后间隙脓肿
C. 肛门周围脓肿
D. 坐骨直肠间隙脓肿
E. 坐骨肛管间隙脓肿

正确答案：C。肛门周围脓肿

解析：该患者男，28岁，胸膝位三点见肛门红肿，有触痛，结合患者的表现，诊断为肛门周围脓肿（C对）。以肛提肌为界,分为肛提肌下部脓肿和肛提肌上部脓肿。肛提肌下部脓肿包括肛周脓肿、坐骨直肠间隙脓肿(D错)、肛管后间隙脓肿；肛提肌上部脓肿包括骨盆直肠间隙脓肿（A错）、直肠后间隙脓肿、高位肌间脓肿。直肠后间隙脓肿(B错)由于位置较深，局部症状大多不明显，主要表现为会阴、直肠部坠胀感，排便时疼痛加重；病人可伴有不同程度的全身感染症状。直肠指诊可触及痛性肿块。坐骨肛管间隙脓肿(E错)又称坐骨肛管窝脓肿。多由肛腺感染穿过外括约肌向外扩散到坐骨肛管间隙而形成。也可由肛周脓肿向深部扩散而成，发病时病侧出现持续性胀痛，逐渐加重，继而为持续性跳痛，排便或行走时疼痛加剧，可有排尿困难和里急后重；脓肿范围较大时全身感染症状明显，如头痛、乏力、发热、食欲缺乏、恶心、寒战等,早期局部体征不明显，以后出现肛门病侧红肿，双臀不对称；局部触诊或直肠指检时病侧有深压痛，甚至波动感。A选项表现与B选项，会有会阴不适，D选项与E选项，会引起排尿问题，患者无排尿和会阴不适，故考虑肛周脓肿